在饮水氯化消毒时随着pH的升高，三卤甲烷的生成量也会
A. 减少
B. 增大
C. 不变
D. 先升高后减少
E. 先减少后增大

正确答案：B。增大

解析：本题考查饮水氯化消毒的相关内容。在饮水氯化消毒时，三卤甲烷的生成与水的pH有关，随着pH的升高，三卤甲烷的生成量也会增大（B对ACDE错）。